通过内囊膝部的下行神经纤维束是
A. 皮质脊髓束
B. 皮质核束
C. 脊髓丘脑束
D. 视辐射
E. 无

正确答案：B。皮质核束

解析：通过内囊膝部的下行神经纤维束是皮质核束（B对）。皮质脊髓束（A错）下行经内囊后肢的前部、大脑脚底中3/5的外侧部和脑桥基底部至延髓锥体。躯干和四肢痛温觉、粗略触觉和压觉传导通路组成组成脊髓丘脑侧束（C错）和脊髓丘脑前束。视辐射（D错）是由外侧膝状体发出的纤维构成。